下列关于麻疹预防、护理的叙述，错误的是
A. 流行期，未患过麻疹的小儿尽量不去公共场所
B. 一旦与麻疹患儿接触，应立即隔离观察
C. 卧室空气要流通
D. 注意补足水分
E. 出疹期间勿洗脸、洗眼

正确答案：E。出疹期间勿洗脸、洗眼

解析：麻疹患儿护理应保持眼睛、鼻腔、口腔、皮肤的清洁卫生，故出疹期间也应洗脸、洗眼（E错，为本题正确答案）。麻疹流行期间，勿带小儿去公共场所和流行区域，减少感染机会（A对）。易感儿接触传染源后，应隔离观察21天。对密切接触的易感儿应隔离检疫3周，已做过免疫接种者观察4周（B对）。应保持卧室空气流通，温度、湿度适宜（C对）。注意补足水分，饮食应清淡、易消化，出疹期忌油腻辛辣之品（D对）。